对于熔点低，受热不稳定及水分难赶除的药物，其干燥失重的测定应使用
A. 常压恒温干燥法
B. 干燥剂干燥法
C. 减压干燥法
D. 气相色谱法
E. 高效液相色谱法

正确答案：C。减压干燥法